胎盘早期剥离
A. 启动内源性凝血系统
B. 启动外源性凝血系统
C. 两者都是
D. 两者都不是
E. 无

正确答案：C。两者都是

解析：在胎盘早期剥离等产科意外等情况下，可释放大量组织因子入血，启动外源性凝血系统，也可导致内皮细胞损伤，胶原暴露，激活FXⅡa，启动内源性凝血系统（C对ABDE错）。